临床治疗伦理决策的原则不包括
A. 根本权益优先准则
B. 多元价值优选准则
C. 变通性操作准则
D. 规范与智慧并重准则
E. 全面考虑，维护社会公益

正确答案：E。全面考虑，维护社会公益

解析：临床治疗伦理决策的原则包括根本权益优先准则，多元价值优选准则，变通性操作准则，规范与智慧并重准则。全面考虑，维护社会公益是临床急救的伦理要求。掌握“临床治疗的伦理决策”知识点。